女，18岁。低热，腹痛、腹泻伴腹胀2个月。体查：腹壁揉面感，腹部移动性浊音阳性。腹水为渗出液。为明确诊断，下列检查最有价值的是
A. 血培养
B. 结核菌素试验
C. 腹膜活检
D. 腹水细菌培养
E. 血沉

正确答案：C。腹膜活检

解析：青年女性患者，低热（结核毒血症状）、腹痛、腹泻伴腹胀2个月。查体：腹壁揉面感（结核性腹膜炎的典型体征），腹部移动性浊音阳性（腹水阳性）。腹水为渗出液（结核性腹膜炎引起腹水为渗出液）。综合患者病史、体检与腹水检查，考虑诊断为结核性腹膜炎，腹膜活检（C对）对其有确诊价值。血培养（A错）很难培养出结核分枝杆菌，且周期长，不用于确诊结核性腹膜炎。结核菌素试验（B错）应用于检出结核分枝杆菌感染，而非检出结核病（P66）。结核性腹膜炎的腹水普通细菌培养结果为阴性，结核分枝杆菌培养的阳性率很低（D错）。血沉（E错）增高可见于多种疾病，如急性炎症、白血病、结缔组织病及结核病的活动期，不具有特异性。